长期暴露在氢氟酸环境下的工人容易发生
A. 骨折
B. 视力模糊
C. 牙齿的酸蚀症
D. 皮肤粗糙
E. 骨质疏松

正确答案：C。牙齿的酸蚀症

解析：暴露于酸性工作环境中的人易患牙酸蚀症，它的患病率及严重程度与接触酸的时间，是否采取保护措施有关。掌握“酸蚀症的预防”知识点。